下列哪种药涂擦后会使牙面变黑不能用于恒前牙
A. 2％氟化钠
B. 8％氟化亚锡
C. 酸性氟磷酸
D. 10％氟化氨银
E. 10％氟化钼酸铵

正确答案：D。10％氟化氨银

解析：本题考查龋病的药物治疗。10％氟化氨银（D错，为本题的正确答案）涂擦后会使牙面变黑不能用于恒前牙。药物治疗也称为非手术治疗，以涂药方法治疗龋病主要适用于龋损面广泛的浅龋或剥脱的环状龋，不易制备洞型的乳牙或恒牙。药物治疗的药物是氟化物，常用的氟化物有2％氟化钠（A对）、8％氟化亚锡（B对）、酸性氟磷酸（C对）、10％氟化钼酸铵（E对），10％氟化氨银可用于治疗将来会脱落的乳牙，由于其易使牙齿局部着色变黑，影响美观，不适用于恒前牙。